纤溶酶
A. 抑制纤维蛋白多聚体的形成
B. 水解纤维蛋白原
C. 激活纤溶酶原
D. 水解凝血因子Ⅲ
E. 增加毛细血管通透性

正确答案：B。水解纤维蛋白原

解析：水解纤维蛋白原（B对D错）产生纤维蛋白（原）降解产物(FgDP或FDP)是纤溶酶的功能。凝血酶使纤维蛋白原转变为纤维蛋白单体，最终形成交联的纤维蛋白多聚体（A错）。激活纤溶酶原（C错）由纤溶酶原激活物激活。血管活性物质可增加毛细血管通透性（E错）。